患者，女，61岁。患风湿痹痛多年，现腰膝酸痛，筋骨痿软无力，脉弦细，首选药物是
A. 独活
B. 秦艽
C. 五加皮
D. 木防己
E. 桑枝

正确答案：C。五加皮

解析：五加皮的功效为祛风除湿，补益肝肾，强筋壮骨，利水消肿。治疗风湿痹病；筋骨痿软，小儿行迟，体虚乏力；水肿，脚气肿痛（C对）。独活的功效为祛风除湿，通痹止痛，解表。治疗风寒湿痹，腰膝疼痛；风寒夹湿头痛；少阴伏风头痛（A错）。秦艽的功效为祛风湿，清湿热，舒筋络，止痹痛，退虚热。治疗风湿痹证，筋脉拘挛，骨节酸痛；中风半身不遂；湿热黄疸；骨蒸潮热，小儿疳积发热（B错）。木防己的功效为祛风湿，止痛，利水消肿。治疗风湿痹痛；水肿，脚气肿痛，小便不利；湿疹疮毒（D错）。桑枝的功效为祛风湿，利关节。治疗风湿痹证，肩臂、关节酸痛麻木（E错）。